通过比较脱钙和不脱钙的牙本质小管直径，可知管周牙本质的厚度在近髓端和与近釉质端的厚度分别为
A. 750nm，400nm
B. 450nm，300nm
C. 400nm，750nm
D. 800nm，350nm
E. 600nm，450nm

正确答案：C。400nm，750nm

解析：通过比较脱钙和不脱钙的牙本质小管直径，可知管周牙本质的厚度在近髓端和与近釉质端分别为400nm，750nm。掌握“牙本质”知识点。